患者手术后，给予肠外营养液10%GS500ml，50%GS250ml，20%脂肪乳250ml，8.5%复方氨基酸750ml，水溶性维生素10ml，脂溶性维生素10ml，微量元素10ml，10%氯化钠注射液40ml，10%氯化钠注射液30ml。营养液中葡萄糖提供的能量是
A. 200kcal
B. 450kcal
C. 700kcal
D. 1150kcal
E. 1550kcal

正确答案：C。700kcal

解析：本题考查肠外营养的配比计算。营养液中葡萄糖含量=10%*500ml+50%*250ml=175g，1g葡萄糖可提供4kcal热量，营养液中葡萄糖提供的能量为4*175=700kcal（C对）。